成年患者，输血100ml后，突感头痛、恶心、寒战高热、呼吸困难、剧烈腰痛，血压下降，可能发生
A. 溶血反应
B. 细菌污染反应
C. 过敏反应
D. 免疫反应
E. 发热反应

正确答案：A。溶血反应

解析：成年患者，输血100ml后，突感头痛、恶心、寒战高热、呼吸困难、剧烈腰痛，血压下降，可能发生的是溶血反应（A对），溶血反应是由于输入血型不符的血后而迅速出现一系列的症状甚至休克，是最严重的输血并发症。细菌污染反应（B错）病人的反应程度依细菌污染的种类、毒力大小和输入的数量而异。临床表现有烦躁、寒战、高热、呼吸困难、恶心、呕吐、发绀、腹痛和休克。过敏反应（C错）多发生在输血数分钟后，多表现为皮肤局限性或全身性瘙痒或荨麻疹。免疫反应（D错）常见于经产妇或多次接受输血者，因体内巳有白细胞或血小板抗体，当再次输血时可与输入的白细胞或血小板发生抗原抗体反应而引起发热。发热反应（E错）多发生于输血开始后15分钟至2小时内，主要表现为畏寒、寒战和高热，同时伴有头痛、出汗、恶心、呕吐及皮肤潮红，血压多无变化。